供应纹状体、内囊的动脉主要来自
A. 大脑中、前动脉中央支
B. 大脑中、前动脉皮质支
C. 前交通动脉中央支
D. 大脑后动脉中央支
E. 大脑后动脉皮质支

正确答案：A。大脑中、前动脉中央支

解析：供应纹状体、内囊的动脉主要来自大脑中、前动脉中央支（A对），其中大脑中动脉的中央支供应尾状核、豆状核、内囊膝和后肢的前部；大脑前动脉的中央支供应尾状核、豆状核前部和内囊前肢。大脑中动脉皮质支供应大脑半球外侧面大部分和岛叶；大脑前动脉皮质支（B错）供应顶枕沟以前的半球内侧面、额叶底面的一部分和额、顶两叶上外侧面的上部。大脑后动脉中央支（D错）供应背侧丘脑、内侧膝状体、下丘脑和底丘脑；大脑后动脉皮质支（E错）供应颞叶的内侧面、底面及枕叶。